处方中“必要时”的外文缩写是
A. Ac
B. pc
C. po
D. qn
E. prn

正确答案：E。prn

解析：本题考查处方中常见的外文缩写及其含义。医师在书写处方正文时会采用拉丁文缩写或者英文缩写表示，其中prn（E对）缩写含义为必要时。Ac（A错）缩写含义为餐前（服）。pc.（B错）缩写含义为餐后。po.（C错）缩写含义为口服。qn.（D错）缩写含义为每晚。